恶阻，口苦，呕吐酸水或苦水者，多为
A. 脾胃虚弱
B. 脾虚痰湿
C. 肝胃不和
D. 肝经湿热
E. 肝郁脾虚

正确答案：C。肝胃不和

解析：素体肝旺，孕后阴血聚下以养胎，肝失血养，肝体不足而肝阳偏亢，且肝脉挟胃贯膈，肝火上逆犯胃，胃失和降故恶心；肝胆互为表里，肝气上逆则胆火随之上升，胆热液泄，故呕吐酸水或苦水（C对）。脾胃虚弱证，恶阻，呕吐清涎（A错）。脾虚痰湿，肝经湿热，肝郁脾虚不属于恶阻的证型（BDE错）。